建（牙合）过程中向前的动力为
A. 唇颊肌
B. 舌肌
C. 咽肌
D. 表情肌
E. 舌骨上肌群

正确答案：B。舌肌

解析：向前的动力：①咬合时产生的咀嚼力、（牙合）力有推动上下牙弓向前发育的作用；②舌肌向前的作用力，以及上下颌骨发育中皆有在其后缘增生新骨的倾向，也使牙列向前方移动。掌握“（牙合）的生长发育”知识点。